下列哪一项不是表寒证的临床表现
A. 恶寒发热
B. 头身疼痛
C. 鼻塞流清涕
D. 无汗
E. 咽喉肿痛

正确答案：E。咽喉肿痛

解析：注意表寒证和里寒证的鉴别。表寒证是指寒邪外袭于肌表，阻遏为阳，阳气抗邪于外所表现的表实寒证，表现为恶寒（A错）、头身疼痛（B错）、无汗（D错）、鼻塞或流清涕（C错）、苔白、脉浮紧等症。中寒证是寒邪直接内侵脏腑、气血，遏制及损伤阳气，阻滞脏腑气机和血液运行所表现的里实寒证。咽喉肿痛为燥淫证的临床表现（E对）。